蜜炙桑叶多用于
A. 清肺热
B. 疏风热
C. 清肝热
D. 清血热
E. 润肺燥

正确答案：E。润肺燥

解析：桑叶具有疏散风热，清肺润燥，平抑肝阳，清肝明目的功效。在中药的炮制中，蜜炙药物常能增强其润肺止咳的功效，故桑叶蜜制能增强润肺止咳的作用，用于肺燥咳嗽（E对）。